以下哪项不是慢性肉芽肿内增生上皮团或上皮条索的来源
A. Malassez上皮剩余
B. 经瘘道口长入的口腔黏膜的上皮或皮肤
C. 牙周袋壁上皮
D. 呼吸道上皮
E. Serres上皮剩余

正确答案：E。Serres上皮剩余

解析：本题考查急慢性根尖周炎。Serres上皮剩余（E错，为本题正确答案）不是慢性肉芽肿内增生上皮团或上皮条索的来源。根尖周肉芽肿内的另一个重要特征是有上皮存在，其上皮来自：①牙周膜的Malassez上皮剩余（A对）；②口腔或皮肤上皮（B对）；③牙周袋上皮（C对）；④呼吸道上皮（D对）。